深龋患者激发痛较重，洞底软龋能够彻底去净，治疗方法应选择
A. 双层垫底，一次完成充填治疗
B. 局麻后开髓失活，行牙髓治疗
C. 先做安抚疗法，待一到二周复诊时症状消除后，再以双层垫底充填
D. 施行活髓切断术
E. 间接盖髓、双层垫底一次完成充填治疗

正确答案：C。先做安抚疗法，待一到二周复诊时症状消除后，再以双层垫底充填

解析：本题考查深龋的治疗方法。深龋患者激发痛较重，说明牙髓充血，应先用氧化锌丁香油安抚后，待牙髓炎症状消失后治疗，深龋患牙一般需双层垫底，先用氢氧化钙衬洞，再垫一层玻璃子或其他垫底材料后充填（C对）。直接垫底充填不进行安抚，将会加重对牙髓的刺激（AE错）。患者为深龋，激发痛较严重，牙髓为充血状态，但牙髓无病变，无需做牙髓治疗及活髓切断术（BD错）。